下列哪项不是月经后期虚寒证的主症
A. 经期延后，量少色淡、质清稀
B. 小腹空痛，心悸失眠
C. 腰酸无力
D. 小便清长，大便稀溏
E. 脉沉迟或细弱无力

正确答案：B。小腹空痛，心悸失眠

解析：月经后期虚证冲任亏虚，血海不能按时满溢而经迟，脏腑经络失于滋养，阴精不足，血不养心脉，出现心悸失眠的症状。空痛多见于头部或小腹部，多由气血精髓亏虚，组织器官失其荣养所致（B对）。阳气不足，阴寒内盛，不能温养脏腑，气血生化不足，气虚血少，冲任不充，血海满溢延迟，故月经推迟而至，量少；阳虚血失温煦，故经色淡红，质稀（A错）。阳虚肾气不足，外府失养，故腰酸无力（C错）。阳虚失煦，阳气不能蒸腾、气化水液，则小便清长，大便稀溏（D错）。阳虚不能生血行血，血脉不充，则脉沉迟或细弱无力（E错）。